药物借助载体或酶促系统，消耗机体能量，从膜的低浓度向高浓度一侧转运的药物转运方式是
A. 主动转运
B. 简单扩散
C. 易化扩散
D. 膜动转运
E. 滤过

正确答案：A。主动转运

解析：本题考查药物的转运方式。主动转运（A对）是药物借助载体或酶促系统，从膜的低浓度一侧向高浓度一侧转运，并且需要消耗机体能量；简单扩散（B错）是顺浓度梯度的运输方式；易化扩散（C错）是借助载体运输的被动转运方式；膜动转运（D错）是细胞膜通过主动变形，膜凹陷吞没将某些物质摄入细胞内或从细胞内释放到细胞外的过程；滤过（E错）是被动转运中的一种，是指水溶性小分子物质依靠膜两侧的流体静压或渗透压通过孔道的过程。